男性的生殖腺
A. 睾丸
B. 附睾
C. 精囊
D. 前列腺
E. 尿道球腺

正确答案：A。睾丸

解析：睾丸（A对）为男性的生殖腺。附睾（B错）为输精管道。精囊（C错）、前列腺（D错）、尿道球腺（E错）均为附属腺。